毒物的特效拮抗剂分为物理性、化学性和生理性三类。下列属于生理性拮抗的情况有
A. 牛乳沉淀重金属
B. 弱酸中和强碱
C. 弱碱中和强酸
D. 阿托品拮抗有机磷中毒
E. 毛果芸香碱拮抗颠茄碱中毒

正确答案：D、E。阿托品拮抗有机磷中毒；毛果芸香碱拮抗颠茄碱中毒

解析：本题考查毒物的特效拮抗剂。生理性拮抗剂能拮抗中毒毒物对机体生理功能的扰乱作用，例如阿托品拮抗有机磷中毒（D对）的毒蕈碱样症状、毛果芸香碱拮抗颠茄碱类（E对）（如曼陀罗）中毒。牛乳沉淀重金属（A错）为物理性拮抗。弱酸中和强碱（B错）、弱碱中和强酸（C错）为化学性拮抗。